在相同应激源作用下而产生不同的应激反应，其主要原因是个体的
A. 体质不同
B. 认知评价不同
C. 敏感强度不同
D. 反应强度不同
E. 文化程度不同

正确答案：B。认知评价不同